不宜与苦杏仁装于一个药斗的饮片是
A. 黄芪
B. 桃仁
C. 鸡血藤
D. 血竭粉
E. 五味子

正确答案：B。桃仁

解析：本题考查的是斗谱排列时还应参考的其他原则。不宜与苦杏仁装于一个药斗的饮片是桃仁（B对）。斗谱排列时还应参考的其他原则：有些药物放在一起可能造成意外事故的发生，因此在摆放时应注意以下几点。（1）属于配伍禁忌的药物，不能装于一斗或上下药斗中。如甘草与京大戟、甘遂、芫花；藜芦与丹参、南沙参、玄参、苦参、白芍、赤芍、细辛；乌头类（附子、川乌及草乌）与半夏的各种炮制品、瓜蒌（瓜蒌皮、瓜蒌子、瓜蒌仁及天花粉）；丁香（包括母丁香）与郁金（黄郁金、黑郁金）；芒硝（包括玄明粉）与京三棱；肉桂（官桂）与石脂（赤石脂）均不宜放在一起。（2）外观性状相似的饮片，尤其是外观形状相似但功效不同的饮片，不宜排列在一起。如蒲黄与海金沙，紫苏子与菟丝子，山药与天花粉，杏仁与桃仁，厚朴与海桐皮，荆芥与紫苏叶，大蓟与小蓟，炙甘草与炙黄芪（A错），当归与独活，制南星与象贝（浙贝），菟丝子与苏子，熟地与黄精，知母与玉竹，蛇床子与地肤子，玫瑰花与月季花，血余炭与干漆炭，韭菜子与葱子等。（3）药名相近，但性味功效不同的饮片不应排列在一起。如附子与白附子，藜芦与漏芦，天葵子与冬葵子等。（4）同一植物来源但不同部位入药的并且功效不相同的饮片不能排列在一起，如麻黄与麻黄根。（5）为防止灰尘污染，有些中药不宜放在一般的药斗内，而宜存放在加盖的瓷罐中，以保持清洁卫生。如熟地黄、龙眼肉、青黛、玄明粉、松花粉、生蒲黄、乳香面、没药面、儿茶面、血竭面（D错）等。（6）有恶劣气味的药物，不能与其他药物装于一个药斗中。如阿魏、鸡矢藤等。（7）贵细药品（价格昂贵或稀少的中药）不能存放在一般的药斗内，应设专柜存放，由专人管理，每天清点账物。如牛黄、麝香、西红花、人参、西洋参、羚羊角、鹿茸、珍珠、冬虫夏草、海龙、海马等。（8）毒性中药和麻醉中药应按照有关规定存放，绝不能放于一般药斗内，必须专柜、专锁、专账、专人管理，严防意外事故的发生。鸡血藤（C错）与五味子（E错）的斗谱排列原则，2022年考试指南未明确说明。